关于抑郁发作的诊断标准，正确的是
A. 病程应持续3月以上
B. 自责、内疚但不能达到妄想程度
C. 特征性睡眠障碍为入睡困难
D. 可出现精神、运动性激越
E. 严重者可出现思维贫乏

正确答案：D。可出现精神、运动性激越

解析：抑郁发作以显著而持久的情感低落为主要表现，伴有兴趣缺乏、快感缺失、思维迟缓、意志活动减少、精神运动性迟滞或激越（D对）、自责自罪、自杀观念和行为、早醒、食欲减退、体重下降、性欲减退、抑郁心境晨重晚轻的节律改变等。病程至少持续2周（A错）。抑郁症患者可有自责内疚表现，严重者达到罪恶妄想（坚信自己犯了某种罪，应该受到惩罚）（B错）。抑郁症患者可表现为入睡困难，辗转反侧，但不是特征性表现（C错），特征性睡眠障碍表现为早醒，一般比平时早醒2~3小时。抑郁发作可表现为思维迟缓，无思维贫乏症状，思维贫乏多见于精神分裂症、脑器质性精神障碍及精神发育迟滞（E错）。